7个月患儿，发热3天，体温39℃，流涕，咳嗽。皮肤出现红色斑丘疹，体温升至40℃。颊粘膜粗糙，可见白色斑点。该患儿需隔离至出疹后
A. 3天
B. 5天
C. 7天
D. 10天
E. 14天

正确答案：B。5天

解析：麻疹属于传染性呼吸道疾病，麻疹患者出疹前后5天均有传染性，一般隔离至出疹后5天（B对），合并肺炎或其他并发症的患者应延长至出疹后10天（D错）。